铁路运输应当采用集装箱或者行李车运输的是
A. 米非司酮片
B. 阿昔洛韦乳膏
C. 可待因
D. 氨酚伪麻美芬片Ⅱ

正确答案：C。可待因

解析：本题考查麻醉药品和精神药品的运输。托运、承运和自行运输麻醉药品和精神药品的，应当采取安全保障措施，防止麻醉药品和精神药品在运输过程中被盗、被抢、丢失。可待因（C对）是麻醉药品，通过铁路运输时应当使用集装箱或者铁路行李车运输。